直肠癌术后，最常用于监测复发的肿瘤标志物是
A. CA199
B. CA153
C. AFP
D. CA242
E. CEA

正确答案：E。CEA

解析：癌胚抗原（CEA）和CA19-9是目前公认的在结直肠癌诊断和术后监测有意义的肿瘤标记物，但认为CEA缺乏对早期结、直肠癌的诊断价值，主要用于预测直肠癌的预后和监测复发（E对A错）。CA153（B错）主要用于乳腺癌患者的治疗监测和预后判断。AFP（甲胎蛋白）（C错）是肝癌的特异性标志物。CA242（D错）缺乏特异性，多与其他肿瘤标志物联合检测。